半表半里证常见的症状是
A. 恶寒发热
B. 但寒不热
C. 但热不寒
D. 寒热往来
E. 长期低热

正确答案：D。寒热往来

解析：本题考查的是寒热往来的临床意义。半表半里证常见的症状是寒热往来（D对）。问寒热，首先要问患者有没有恶寒发热的症状。如有寒热，就必须问清恶寒与发热是同时出现，还是单独出现，问清寒热的轻重、出现的时间、寒热的特点，以及寒热的兼症等。1.恶寒发热（A错）同见的临床意义：恶寒发热同见，多见于外感表证。疾病初起即有恶寒发热，是外邪客于肌表，卫阳与邪气相争的反映。2.但寒不热（B错）的临床意义：但寒不热，指的是在疾病过程中，患者唯感畏寒而不发热，多属虚寒证。3.但热不寒（C错）的临床意义：但热不寒，指的是在疾病过程中，患者唯感有热而没有寒象，同时怕热，此类症状多属热证的表现。发热不恶寒而但恶热，临床常见有以下几种情况。（1）壮热：壮热，指患者高热不退、不恶寒反恶热，称为壮热。多见于风寒入里化热，或风热内传的里实热证。（2）潮热：潮热，指发热如潮有定时、按时而发或按时而热更甚的（一般多在下午），即为潮热。（3）长期低热（E错）：长期低热，指发热日期较长，而热度仅较正常体温稍高（一般不超过38℃），或仅患者自觉发热而体温并不高者。长期低热的病机比较复杂。4.寒热往来的临床意义：寒热往来，指恶寒与发热交替发作，是半表半里证的特征，为邪气虽不太盛，正气却也不强，邪气既不能侵入于里，正气也不能祛邪使之出表，正邪交争，两不相下的表现。